绒毛膜癌首选的治疗方法是
A. 生物治疗
B. 手术治疗
C. 放射治疗
D. 化学药物治疗
E. 中药治疗

正确答案：D。化学药物治疗

解析：绒毛膜癌是一种高度恶性的肿瘤，继发于葡萄胎、流产或足月分娩以后。绒毛膜癌首选的治疗方法是化学药物治疗（D对），以手术治疗（B错）和放射治疗（C错）为辅。生物治疗（A错）对绒毛膜癌治疗效果不佳。中药治疗（E错）对绒毛膜癌的治疗作用仍有待考察。